在气雾剂中，聚山梨酯80可作为
A. 助悬剂
B. 絮凝剂
C. 潜溶剂
D. 润湿剂
E. 抛射剂

正确答案：D。润湿剂

解析：本题考查气雾剂的附加剂。润湿剂（D对）系指能够增加疏水药物微粒被水润湿能力的物质，聚山梨酯为非离子表面活性剂，是常用的润湿剂。